以下关于颌面部骨源性肉瘤的描述，不正确的是
A. 青年及儿童多见
B. 呈进行性骨膨胀性生长
C. 软骨肉瘤常转移至肺、脑等部位
D. 骨肉瘤虽然易发生远处转移，但与长骨骨内瘤相比，相对少见
E. 皮肤表面常有血管扩张及充血

正确答案：C。软骨肉瘤常转移至肺、脑等部位

解析：骨源性肉瘤可发生远处转移，骨肉瘤最常见，转移部位以肺、脑为多，但与长骨骨肉瘤比较，则相对为少见。骨恶性纤维组织细胞瘤则常发生区域性淋巴结转移。软骨肉瘤则少有转移倾向，无论是血循或淋巴道转移。掌握“肉瘤”知识点。